最易触及尺神经的部位是
A. 腋窝内
B. 上臂中份
C. 肘部内上髁后方
D. 前臂
E. 腕部

正确答案：C。肘部内上髁后方

解析：尺神经从腋动、静脉之间穿出腋窝，在肱二头肌内侧沟伴行于肱动脉内侧至臂中部。继而穿内侧肌间隔至臂后区内侧，下行进入肱骨内上髁后方的尺神经沟，所以在肱骨内上髁后方的尺神经沟（C对）可以触及尺神经。